菌痢
A. 受感染的人作为传染源
B. 受感染的动物作为传染源
C. 两者都是
D. 两者都不是

正确答案：A。受感染的人作为传染源

解析：本题考查细菌性痢疾的传染源。细菌性痢疾的传染源主要包括被病原体污染的食物和受感染的人（A对BCD错）。